呕吐实证，因邪气犯胃，浊气上逆所致者，其治法是
A. 和胃理气，降逆止呕
B. 理气疏肝，和胃降逆
C. 祛邪化浊，和胃降逆
D. 和胃降逆，消食导滞
E. 理气化痰，和胃降逆

正确答案：C。祛邪化浊，和胃降逆

解析：题中所言邪气犯胃，浊气上逆而引起的呕吐，治疗应以祛邪化浊，和胃降逆为法（C对）。和胃理气，降逆止呕的治法未提及祛邪（A错）。因气郁伤肝，肝气横逆犯胃。本证常因情志所伤而诱发，证见胃脘胀满，气逆攻痛连胁，嗳气频频，得气则舒，舌苔薄白，脉弦。治则舒肝理气和胃降逆。本题题目是外邪引起，非情志所伤（B错）。和胃降逆，消食导滞多用于食积，饮食内伤（D错）。理气化痰，和胃降逆用于治疗气机失常，痰浊引起的病证（E错）。